下列文献中，具有信息量大、周期短，报道快等特点的是
A. 期刊
B. 索引
C. 文摘
D. 专著
E. 教科书

正确答案：A。期刊

解析：本题考查药物信息的分类。期刊（A对）属于一级文献，一级文献信息量大，周期短，报道快。索引（B错）便于搜索、使用。文摘（C错）方便、简略确切。专著（D错）信息全面详实，但更新不及时。教科书（E错）信息全面详实，但更新不及时。